下列哪项不是感染性休克的特点
A. 发病机制复杂
B. 易导致心力衰竭
C. 早期常伴有高热
D. 细胞可发生继发性或原发性损伤
E. 大部分病例属于高动力型休克

正确答案：D。细胞可发生继发性或原发性损伤

解析：感染性休克即脓毒性休克的发病机制复杂（A对），尚有待进一步研究阐明，病原体或其毒素侵入机体后病原体或其毒素侵入机体后，引起高代谢和高动力循环状态，即出现发热（C对）、心排出益增加、外周阻力降低、脉压增大等临床特点。此外，细菌毒素及炎症介质可损伤心肌细胞（D对），造成心力衰竭（B对）。细胞可发生继发性或原发性损伤（D错，为本题正确答案）不是感染性休克的特点。